下列不是导致牙列缺失原因的是
A. 龋病
B. 牙周病
C. 外伤
D. 吸烟
E. 不良修复体

正确答案：D。吸烟

解析：导致牙列缺失最常见的两个病因为龋病和牙周病，此外，全身疾病、外伤、发育异常等。掌握“牙列缺失后的病因及影响”知识点。